白质前连合的描述，正确的是
A. 传导痛温觉的一级纤维在此交叉越边
B. 几个节段损伤后，出现双侧节段性对称性痛温觉障碍
C. 几个节段损伤后，出现躯体双侧节段性对称性所有浅感觉消失
D. 几个节段损伤后，本体感觉不存在
E. 所有传导非意识性本体感觉的纤维不在此交叉

正确答案：B。几个节段损伤后，出现双侧节段性对称性痛温觉障碍

解析：白质前连合传导双侧躯体的温痛觉，若病变侵犯了白质前连合，则阻断了脊髓丘脑束在此的交叉纤维，引起双侧对称分布的痛、温觉消失，而本体感觉和精细触觉无障碍（B对）。